哪项不是职业病诊断依据
A. 职业史
B. 遗传史
C. 实室检查
D. 相关症状体征
E. 集体诊断

正确答案：B。遗传史